1996年共发生200例某病病人，在1996年年初已知有800例病人，年内因该病死亡40例，年中人口数1000万，如果该病的发生和因该病死亡的事件均匀分布在全年中，则：1996年期间，该病的患病率（1/10万）
A. 0.4
B. 8
C. 10
D. 1.6
E. 2

正确答案：C。10

解析：本题考查期间患病率的计算。期间患病率＝某观察期间某人群中某病的新旧病例数/同期的平均人口数＝（800＋200）/1000万＝10（C对ABDE错）/10万。